属于程序性细胞死亡蛋白-1（PD-1）抑制剂的抗肿瘤药物是
A. 干扰素
B. 帕博利珠单抗
C. 白介素
D. 贝伐珠单抗
E. 利妥昔单抗

正确答案：B。帕博利珠单抗

解析：本题考查抗肿瘤药物的分类。属于程序性细胞死亡蛋白-1（PD-1）抑制剂的抗肿瘤药物是帕博丽珠单抗（B对）。程序性细胞死亡蛋白-1 （PD-1）抑制剂的抗肿瘤药物：帕博丽珠单抗、纳武利尤单抗。贝伐珠单抗（D错）、利妥昔单抗（E错）属于单克隆抗体。干扰素（A错）、白介素（C错）为其他免疫调节剂。